六淫邪气中，具有“重浊”特点的是
A. 风
B. 寒
C. 暑
D. 湿
E. 火

正确答案：D。湿

解析：该题考查六淫邪气的性质与致病特征。风邪致病具有善动不居、轻扬开泄等特性（A错）。寒邪致病具有寒冷、凝结、收引的特性（B错）。暑邪致病具有炎热、升散的特性（C错）。湿邪致病具有重浊、黏滞、趋下的特性（D对）。火邪致病具有炎热升腾等特性（E错）。